脊髓灰质炎混和疫苗在一岁以内应接种几次
A. 1次
B. 2次
C. 3次
D. 4次
E. 5次

正确答案：C。3次

解析：2个月时脊髓灰质炎三型混合疫苗（第1次）。3个月时脊髓灰质炎三型混合疫苗（第2次）。4个月时脊髓灰质炎三型混合疫苗（第3次）。掌握“儿童保健原则”知识点。